患者男，腰背部疼痛20天，左侧膝关节、左下肢踝关节疼痛，晨起明显，活动后缓解，“4”字实验阳性，既往有虹膜炎病史。有效检查选择
A. HLA-B27
B. 类风湿因子
C. 关节液检查
D. 关节X线
E. 抗环瓜氨酸多肽抗体

正确答案：D。关节X线

解析：患者男，腰背部疼痛20天（强直性脊柱炎的首发症状），左侧膝关节、左下肢踝关节疼痛（附着点出现疼痛），晨起明显，活动后缓解（典型临床表现），“4”字实验阳性，既往有虹膜炎病史（关节外症状）。根据患者的临床表现，考虑为强直性脊柱炎。强直性脊柱炎：骶髂关节CT＞骶髂关节X线＞HLA-B27。